患者发热，无力，食欲不振，腹痛，以左下腹明显，腹泻早期稀便，大便次数增多后转为黏液脓血便，并有里急后重，应诊断为
A. 急性胃肠炎
B. 急性细菌性痢疾
C. 肠伤寒
D. 食物中毒
E. 肠阿米巴痢疾

正确答案：B。急性细菌性痢疾

解析：患者发热、腹痛、腹泻，排粘液脓血便，并有里急后重，全身中毒症状较轻，应诊断为急性普通型细菌性痢疾（B对）。急性胃肠炎（P165）（A错）常有腹痛腹泻，无里急后重。伤寒（P149）（C错）多表现为长期稽留热，表情淡漠，相对缓脉，便秘较常见。食物中毒（P157）（D错）好发于夏秋季，多有不洁饮食史，常表现为急性起病，同餐人员同时多人起病，粪便镜检白细胞不超过5个/HP等。肠阿米巴痢疾（P272）（E错）无发热，便量多，为暗红色，有腥臭味。